患者，男，50岁。慢性支气管炎急性发作，咳嗽气粗，咯痰不爽，胸胁胀满，面赤，舌红苔黄腻，脉滑数有力。其治法是
A. 清热化痰
B. 清肺降气
C. 疏风清热
D. 疏风祛湿
E. 养阴润肺

正确答案：A。清热化痰

解析：患者慢性支气管炎急性发作，痰热郁阻肺气，肺失清肃，故咳嗽气粗，咯痰不爽；热伤肺络故见胸胁胀满；肺内郁热故见面赤；舌红苔黄腻，脉滑数有力，均为痰热郁肺的表现，治法为清热化痰，宜肺止咳（A对）。清肺降气（B错）用于治疗肺热气逆证。疏风清热（C错）用于治疗风热犯肺证。疏风祛湿（D错）用于治疗风湿袭肺证。养阴润肺（E错）治疗肺阴亏虚证。